婴幼儿缺锌可导致以下改变，但除外
A. 异食癖或味觉异常
B. 食欲缺乏
C. 生长停止
D. 认知行为改变
E. 龋齿

正确答案：E。龋齿